患者，男，50岁，高血压病史3年。期间先后用硝苯地平片和硝苯地平控释片控制血压，近日出差曾饮酒和引用多种饮料，出现血压波动情况。关于本例患者对硝苯地平片和硝苯地平控释片的用法，正确的是
A. 控释片比普通片剂含量高，不宜嚼碎服用，不然会导致低血压
B. 控释片比普通片起效快，作用时间长
C. 控释片比普通片剂含量相同，可以固定时间替换服用
D. 控释片一般一日三次给药，与普通片给药次数相同
E. 控释片比普通片剂起效慢，血浆峰尝试高，容易发生头晕、注意力不集中、记忆呼减退。肢体麻木、夜尿增多、心悸、胸闷、乏力等

正确答案：A。控释片比普通片剂含量高，不宜嚼碎服用，不然会导致低血压

解析：本题考查各种剂型的正确使用。硝苯地平控释片比普通片剂含量高，不宜嚼碎服用，不然会导致低血压（A对）。控释片是能把一天服用3～4次的药物变成1～2次完成，其每片的含量是普通片剂的1.5～3倍（BC错）。缓、控释制剂每日仅用1～2次（D错）。控释片控制药物的释放速度，与普通片剂的效果相同（E错）。